属于牙周疾病二级预防内容的是
A. 建立良好的口腔卫生习惯
B. 掌握正确刷牙方法，提高宿主的抗病能力
C. 口腔健康教育和指导
D. 修复失牙，重建功能
E. 减轻牙周疾病的严重程度，控制其发展

正确答案：E。减轻牙周疾病的严重程度，控制其发展

解析：二级预防旨在早期发现、早期诊断、早期治疗，减轻已发生的牙周病的严重程度，控制其发展。对局限于牙龈的病变，及时采取专业性洁治，去除菌斑和牙石。控制其进一步发展。采用X线检查法定期追踪观察牙槽骨情况，根据具体情况采取适当的治疗，改善牙周组织的健康状况。二级预防的效果是在一级预防基础上取得的，其远期效果与患者是否能长期坚持各种预防措施有关。掌握“牙周病流行病学及分级预防”知识点。